治疗眩晕时，属肝火上扰者，宜选用的中成药是
A. 杞菊地黄丸
B. 半夏天麻丸
C. 通天口服液
D. 当归龙荟丸
E. 十全大补丸

正确答案：D。当归龙荟丸

解析：本题考查的是眩晕的辨证论治。治疗眩晕时，属肝火上扰者，宜选用的中成药是（D对）。眩晕之肝阳上亢证【症状】眩晕，耳鸣，头目胀痛，口苦，失眠多梦，遇烦劳郁怒而加重，颜面潮红，急躁易怒。舌红苔黄，脉弦或数。【中成药应用】常用中成药有当归龙荟丸、天麻钩藤颗粒、松龄血脉康胶囊、复方罗布麻颗粒。眩晕之肾精不足证【症状】眩晕日久不愈，精神萎靡，两目干涩，视力减退，腰膝酸软，或遗精滑泄，耳鸣齿摇，颧红咽干，五心烦热。舌红少苔，脉细数。【中成药应用】常用中成药有左归丸、古汉养生精、杞菊地黄丸（A错）。眩晕之痰湿中阻证【症状】眩晕，头重昏蒙，或伴视物旋转，胸闷恶心，呕吐痰涎，食少多寐。舌苔白腻，脉濡。【中成药应用】常用中成药有半夏天麻丸（B错）、眩晕宁颗粒、晕复静片。通天口服液（C错）为瘀血头痛的中成药应用。头痛之瘀血头痛【症状】头痛经久不愈，痛处固定不移，痛如锥刺，或有头部外伤史。舌紫暗，或有瘀斑，瘀点，苔薄白，脉细或细涩。【中成药应用】常用中成药有血府逐瘀口服液、通天口服液、逐瘀通脉胶囊、丹七片。十全大补丸（E错）为月经过多气虚证的中成药应用。月经过多之气虚证【症状】经行最多，色淡红，质清稀；神疲肢倦，气短懒言，小腹空坠，面色㿠白。舌淡，苔薄，脉细弱。【中成药应用】常用中成药有当归丸、益气养元颗粒、八珍颗粒、十全大补丸。